组成新纹状体的是
A. 尾状核和豆状核
B. 尾状核和豆状核的壳部
C. 豆状核和苍白球
D. 尾状核和背侧丘脑
E. 豆状核的壳和背侧丘脑

正确答案：B。尾状核和豆状核的壳部

解析：纹状体由尾状核和豆状核组成，由于尾状核和豆状核的壳在种系发生上属于新的结构，因此尾状核和豆状核的壳部（B对）是合称新纹状体。